骨源性肉瘤最常发生于
A. 颧骨
B. 鼻骨
C. 颅骨
D. 蝶骨
E. 颌骨

正确答案：E。颌骨

解析：骨源性肉瘤可发生于任何颌面骨，但以上下颌骨为最常见。掌握“肉瘤”知识点。